应激的概念可理解为
A. 外界刺激和环境要求
B. 对外界刺激和环境要求的反应
C. 对环境不适应或适应的反应
D. 对环境要求与应付能力评估后的状态
E. 内外刺激因素

正确答案：D。对环境要求与应付能力评估后的状态